某女，45岁。因月经不调就诊，症见月经提前，经期延长，经血暗红，量少，咽干颧红，心烦潮热，腰膝酸软；舌红苔少，脉沉细无力。治以滋补肝肾、止血调经，处方如下：熟地黄12g，生山药9g，山萸肉9g，枸杞子9g，菟丝子12g，川牛膝9g，制何首乌12g，黄芩6g，女贞子12g，墨旱莲9g，仙鹤草12g，夏枯草9g，西洋参（另煎）6g，鹿角胶（烊化）6g，龟甲胶（烊化）9g；14剂，水煎服，每日1剂，早晚分服。该患者停用汤药后，食欲不振、厌油腻、巩膜黄染等症状逐渐好转，执业药师对其所服用的汤药与不良反应的关联性进行评价，评价结果应判定为
A. 肯定
B. 很可能
C. 可能
D. 可能无关
E. 待评价

正确答案：B。很可能

解析：本题考查关联性评价标准。可判定为很可能（B对）。关联性评价标准：①肯定（A错）：用药及反应发生时间顺序合理；停药以后反应停止，或迅速减轻或好转（根据机体免疫状态某些ADR反应可出现在停药数天以后）；再次使用，反应再现，并可能明显加重（即激发试验阳性）；同时有文献资料佐证；并已排除原患疾病等其他混杂因素影响。②很可能：无重复用药史，余同‘肯定’，或虽然有合并用药，但基本可排除合并用药导致反应发生的可能性。③可能（C错）：用药与反应发生时间关系密切，同时有文献资料佐证；但引发ADR的药品不止一种，或原患疾病病情进展因素不能除外。④可能无关（D错）：ADR与用药时间相关性不密切，反应表现与已知该药ADR不相吻合，原患疾病发展同样可能有类似的临床表现。⑤待评价（E错）：报表内容填写不齐全，等待补充后再评价，或因果关系难以定论，缺乏文献资料佐证。⑥无法评价：报表缺项太多，因果关系难以定论，资料又无法补充。